不宜用作嵌体修复的材料是
A. 复合树脂
B. 自凝树脂
C. 烤瓷
D. 铸造陶瓷
E. 金属

正确答案：B。自凝树脂

解析：本题考查嵌体修复的材料。自凝树脂（B错，为本题正确答案）耐磨性能差，长期使用可能会导致远期的继发龋，引发不良的咬合问题等，故不宜用作嵌体修复的材料。嵌体是一种嵌入牙体内部，用以恢复缺损牙体形态和功能的修复体或冠内固位体。制作嵌体的材料应使用机械性能优良的金属材料（E对）和耐磨性能较好的瓷材料如烤瓷（C对）、铸造陶瓷（D对）与复合树脂（A对）。